判断骨龄常用的检测手段是
A. CT扫描技术
B. 磁共振
C. X线摄片
D. B超
E. 透视

正确答案：C。X线摄片